关于病例对照研究中配比的目的，哪一项论述是错误的
A. 使两组的某些特征或变量相一致
B. 研究外部因素对研究结果的影响
C. 控制外部因素对研究结果的干扰
D. 在病例数很少时可使用配比方法进行研究
E. 平衡混杂因素对病例组和对照组的影响

正确答案：B。研究外部因素对研究结果的影响